国家对药品生产、经营单位实行药品安全信用分类管理。首次被处以撤销药品广告批准文号的企业，属于
A. 失信等级
B. 严重失信等级
C. 警示等级
D. 守信等级

正确答案：A。失信等级

解析：本题考查药品安全信用等级。国家对药品生产、经营单位实行药品安全信用分类管理。首次被处以撤销药品广告批准文号的企业，属于失信等级（A对）。药品安全信用等级分为守信、警示、失信、严重失信四级。确定药品安全信用等级的原则为：①以是否有因违反药品、医疗器械监督管理法律、法规和规章等而被处以刑事或者行政处罚作为信用等级划分的主要标准；②以违法行为情节的轻重和主观过错的大小作为信用等级划分的辅助标准。（1）守信等级（D错）：正常运营的药品、医疗器械生产、经营企业和研制单位在一年内无违法违规行为。（2）警示等级（C错）：①因违法违规行为受到警告，被责令改正的；②药品经营企业、医疗机构有充分证据证明其不知道所销售或者使用的药品是假药、劣药，受到没收其销售或者使用的假药、劣药和违法所得处罚的。（3）失信等级：①因实施同一违法行为被连续警告、公告两次以上的；②被处以罚款、没收违法所得、没收非法财物或者被撤销药品、医疗器械广告批准文号的。（4）严重失信等级（B错）：①连续被撤销两个以上药品、医疗器械广告批准文号的；②被撤销批准证明文件、责令停产停业、暂扣生产（经营）许可证、暂扣营业执照的；③药品企事业单位拒绝、阻挠执法人员依法进行监督检查、抽验和索取有关资料或者拒不配合执法人员依法进行案件调查的；④因违反药品、医疗器械监督管理法律、法规构成犯罪的。